定量鼻用气雾剂应检查的是
A. 黏附力
B. 装量差异
C. 递送均一性
D. 微细粒子剂量
E. 沉降体积比

正确答案：C。递送均一性

解析：本题考查递送均一性检查。定量鼻用气雾剂应做递送剂量均一性（C对）检查；黏附力（A错）是贴剂的检查项目；装量差异（B错）是单剂量包装制剂的检查项目；微细粒子剂量（D错）是气雾剂的检查项目；沉降体积比（E错）是混悬型滴鼻剂检查项目。